有关行政机关对公民可以当场作出行政处罚决定的是
A. 五十元以下罚款
B. 五十元以上罚款
C. 一千元以上罚款
D. 一千元以下罚款
E. 二千元以下罚款

正确答案：A。五十元以下罚款

解析：本题考查当场处罚程序。有关行政机关对公民可以当场作出行政处罚决定的是五十元以下罚款（A对）。当违法事实清楚、有法定依据、拟作出数额较小的罚款（对公民处50元以下，对法人或者其他组织处1000元以下（D错）的罚款）或者警告时，可以适用简易程序，当场处罚。